女，22岁。每逢路过商店时就会有被售货员怀疑偷窃的想法，无法自制，十分痛苦。遂到心理门诊寻求帮助，心理治疗师指导其每当出现该想法时就用力拉弹手腕上的橡皮筋，使其产生疼痛，从而逐步消除其强迫症状。这种治疗方法属于
A. 厌恶疗法
B. 系统脱敏疗法
C. 习惯转换法
D. 冲击疗法
E. 代币疗法

正确答案：A。厌恶疗法

解析：厌恶疗法是行为疗法的一种，通过轻微的惩罚来消除适应不良行为，主要适应症是露阴癖、恋物癖、酒精依赖、强迫症等。本例中患者的出现被怀疑偷窃想法时候拉弹橡皮筋产生疼痛，产生厌恶体验，反复实施后，被猜疑偷窃的想法和厌恶体验建立一定的条件联系，使得患者一产生被怀疑偷窃的想法就会产生厌恶体验，从而放弃强迫症状，这种方法是厌恶疗法（A对）。系统脱敏疗法（B错）是治疗师帮助患者建立与不良行为反应相对抗的松弛条件反射，然后在接触引起这种行为的条件刺激中，将习得的放松状态用于抑制焦虑反应，使不良行为逐渐消退（脱敏），最终使不良行为得到矫正。冲击疗法（D错）是让病人一下子面对最高等级惧怕的情况，甚至过分地与惧怕的情况接触。由于惧怕刺激的“泛滥性”的来临，个体面对过分的惧怕刺激，恐怖反应可能会逐渐减轻，甚至最终消失。代币法（E错）是用奖励强化所期望的行为，用惩罚消除不良行为而达到目的。